患者，男，66岁，2型糖尿病，长期口服二甲双胍，格列美脲。近日查空腹血糖12.3mmol/L，糖化血红蛋白9.0%，主诊医师加用“甘精胰岛素每日1次＋门冬胰岛素每日3次”，关于该患者药物治疗方案的说法，正确的是
A. 门冬胰岛素应在三餐前30分钟皮下注射
B. 因采用一日多次胰岛素治疗，格列美脲应停用
C. 患者为2型糖尿病，加用胰岛素一日4次方案不适宜
D. 甘精胰岛素应避免与二甲双胍联合使用
E. 因采用一日多次胰岛素治疗，二甲双胍应停用

正确答案：B。因采用一日多次胰岛素治疗，格列美脲应停用

解析：本题考查胰岛素的应用。因采用一日多次胰岛素治疗，格列美脲应停用（B对）。主诊医师加用“甘精胰岛素每日1次＋门冬胰岛素每日3次”治疗属于胰岛素多次注射，格列美脲属于磺酰脲类胰岛素分泌促进剂，采用多次胰岛素治疗时应停用促胰岛素分泌剂。二甲双胍（E错）是双胍类降糖药，不是胰岛素分泌促进剂。门冬胰岛素应在紧邻餐前注射或餐后立即给药（A错）。可以采用餐时+基础胰岛素（2～4次/日）（C错）或每日2～3次预混胰岛素进行胰岛素强化治疗。甘精胰岛素可以与二甲双胍联合使用（D错）。